属于“水”的味是
A. 酸
B. 苦
C. 甘
D. 辛
E. 咸

正确答案：E。咸

解析：味、五行、脏腑的对应关系：咸-水-肾（E对）。酸（A错）-木-肝。苦（B错）-火-心。甘（C错）-土-脾。辛（D错）-金-肺。